从饮食中吸收的营养物质是
A. 正气
B. 邪气
C. 谷气
D. 元气
E. 四气

正确答案：C。谷气

解析：本题考查的是谷气的生理功能。从饮食中吸收的营养物质是谷气（C对）。谷气，即水谷精气，来源于饮食物，通过脾胃运化功能而生成。正气（A错），是指存在于人体、具有抗邪愈病作用的各种物质与功能的总称。邪气（B错），是指存在于外在环境中，或人体内部产生的具有致病作用的各种因素的总称。元气（D错）的生理功能：推动和促进人体的生长发育，温煦和激发各脏腑、经络等组织器官的生理活动。四气（E错），指中药的寒、热、温、凉四种性质和作用。